食品中多环芳烃的主要来源是
A. 煤、碳烘烤的食物
B. 过高温度烹调的食物
C. 受机油和包装材料污染的食物
D. 以上皆是
E. 以上皆否

正确答案：D。以上皆是